计算某地某年孕产妇死亡率的分母是
A. 某地某年年中妇女人口数
B. 某地某年年末妇女人口数
C. 某地某年年中15～49岁育龄妇女数
D. 某地某年年末15～49岁育龄妇女数
E. 某地某年活产数

正确答案：E。某地某年活产数